治疗疳积，应首选
A. 印堂
B. 二白
C. 太阳
D. 四缝
E. 八风

正确答案：D。四缝

解析：该题考查常用奇穴的主治病证。印堂穴主治痴呆、痫病、失眠、健忘等神志病证；头痛、眩晕；鼻衄、鼻渊；小儿惊风、产后血晕、子痫（A错）。二白穴主治痔疾，脱肛；前臂痛，胸胁痛（B错）。太阳穴主治头痛，目疾，面瘫（C错）。四缝穴主治小儿疳积，百日咳（D对）。八风穴主治足跗肿痛，趾痛；毒蛇咬伤；脚气（E错）。